粪便和有机垃圾堆肥法原理是
A. 在适宜条件下和微生物作用形成腐殖质
B. 在有氧条件下发生化学分解达到无机化
C. 在密闭容器内氧化分解，达到无害化
D. 在密闭容器内氧化分解，再在厌氧菌作用下发酵腐熟
E. 以上都不是

正确答案：A。在适宜条件下和微生物作用形成腐殖质

解析：本题考查粪便和有机垃圾堆肥法的原理。粪便和有机垃圾堆肥法是一种有机肥料的制作方法，它是通过将粪便和有机垃圾进行发酵，使其产生有机肥料的过程。其原理是：在适宜的温度、湿度和氧气条件下，粪便和有机垃圾中的有机物质会受到微生物的作用，经过发酵、氧化、酸化等过程，最终形成腐殖质（A对BCDE错），这种腐殖质可以作为有机肥料使用。